为了有利于干燥，增强气味或减小刺激性，促使药材变色，常采用的产地加工方法是
A. 蒸透心
B. 发汗
C. 熏硫
D. 切片
E. 曝晒

正确答案：B。发汗

解析：本题考查的是中药材常用的产地加工方法。为了有利于干燥，增强气味或减小刺激性，促使药材变色，常采用的产地加工方法是发汗（B对）。常用的产地加工方法：1.拣、洗：将采收的新鲜药材除去泥沙杂质和非药用部分。但具芳香气味的药材一般不用水洗，如薄荷、细辛、木香等。鲜用药材洗后晾干，进行保鲜处理。2.切片（D错）：较大的根及根茎类、坚硬的藤木类和肉质的果实类药材有的趁鲜切成块、片，以利干燥。如大黄、鸡血藤、木瓜。但对具挥发性成分和有效成分易氧化的则不宜切成薄片干燥，如当归、川芎等。3.蒸、煮、烫：含浆汁、淀粉或糖分多的药材，用一般方法不易干燥，需先经蒸、煮或烫的处理，则易干燥，同时使一些药材中的酶失去活力，不致分解药材的有效成分。但加热时间的长短不等，视药材的性质而定，如天麻、红参蒸至透心（A错），白芍煮至透心，太子参置沸水中略烫。有些动物药，如桑螵蛸、五倍子蒸至杀死虫卵或蚜虫。4.搓揉：有些药材在干燥过程中皮、肉易分离而使药材质地松泡，在干燥过程中要时时搓揉，使皮、肉紧贴，达到油润、饱满、柔软或半透明等目的。如玉竹等。5.发汗：有些药材在加工过程中为了促使变色，增强气味或减小刺激性，有利于干燥，常将药材堆积放置，使其发热、“回潮”，内部水分向外挥散，这种方法称为“发汗”，如厚朴、杜仲、玄参、续断、茯苓等。6.干燥：除少数药材，如石斛、鱼腥草、地黄、益母草等，有时要求鲜用外，大多数药材经加工后均应及时干燥。干燥的目的是除去新鲜药材中的大量水分，避免发霉、变色、虫蛀以及有效成分的分解和破坏，保证药材质量，利于贮藏。《中国药典》规定药材产地加工的干燥方法如下。（1）烘干、晒干、阴干均可的，用“干燥”表示。（2）不宜用较高温度烘干的，则用“晒干”或“低温干燥”（一般不超过60℃）表示。（3）烘干、晒干均不适宜的，用“阴干”或“晾干”表示。（4）少数药材需要短时间干燥，则用“曝晒（E错）”或“及时干燥”表示。近年来常使用的还有远红外加热干燥、微波干燥、冷冻干燥等新方法干燥药材。熏硫（C错）：有的中药材在加工或储藏中常使用硫黄熏蒸以达到杀菌防腐、漂白药材的目的。